有防腐作用的是
A. PVP
B. PEG
C. A和B均用
D. A和B均不用

正确答案：D。A和B均不用

解析：本题考查液体制剂常用的附加剂。PVP和PEG均不用作防腐剂使用（D对）。聚维酮（PVP）是一种水溶性的合成聚合物,主要成分为N-乙烯吡咯烷酮，是一种具有高效黏合性的聚合物；聚乙二醇（PEG）为环氧乙烷的寡聚物或聚合物。